关于第3心音，正确的描述是
A. 性质清脆
B. 产生于舒张晚期
C. 正常成人均可闻及
D. 在心尖部外侧听诊最清楚
E. 音调低

正确答案：E。音调低

解析：第3心音出现在心室舒张早期（B错）、快速充盈期之末，认为是由于心室快速充盈的血流冲击室壁，使心室壁、腱索和乳头肌突然紧张、振动所致，可在部分青少年中听及（C错）。听诊特点为音调轻而低（E对A错），局限于心尖部或其内上方（D错）。